下列激素中，能最显著地促进胰岛素分泌的是
A. 抑胃肽
B. 促胃液素
C. 促胰液素
D. 生长素
E. 皮质醇

正确答案：A。抑胃肽

解析：抑胃肽（GIP）又称为葡萄糖依赖性促胰岛素多肽，通过生理性调节促进胰岛素的分泌，这一调节属于前馈控制能显著地促进胰岛素的分泌（A对）。促胃液素（B错）、促胰液素（C错）、生长激素（D错）、皮质醇（E错）及甲状腺激素均可通过升高血糖间接刺激胰岛素分泌，作用较弱。